脾气虚病人常见的面色是
A. 青黄
B. 萎黄
C. 青紫
D. 晦暗
E. 枯槁

正确答案：B。萎黄

解析：本题考查的是脾气虚证的临床表现及辨证要点。脾气虚病人常见的面色是萎黄（B对）。脾气虚证的临床表现及辨证要点：由于素体虚弱，劳倦与饮食不节等，内伤脾气，以致脾气虚弱。临床上常见脾虚证候可分三类：（1）脾失健运证：临床表现常见食纳减少，食后作胀，或肢体浮肿，小便不利，或大便溏泻，时息时发，并伴有身倦无力、气短懒言、面色萎黄、舌质淡嫩、苔白、脉缓弱。以运化功能减退和气虚证共见为辨证要点。（2）脾虚下陷证：临床表现常见子宫脱垂，脱肛，胃下垂，慢性腹泻，并见食纳减少，食后作胀，少腹下坠，体倦少气，气短懒言，面色萎黄，舌淡苔白，脉虚。一般以脾气虚和内脏下垂为辨证要点。（3）脾不统血证：临床表现常见面色苍白或萎黄，饮食减少，倦怠无力，气短，肌衄，便血以及妇女月经过多，或崩漏，舌质淡，脉细弱。一般以在脾气虚的基础上共见出血为辨证要点。面色青紫（C错）见于心血瘀阻。心血瘀阻，可见面色青紫，脉弦涩或结代等。面色晦暗（D错）可见于血瘀证。血瘀证的临床表现，常见局部肿胀疼痛，痛如针刺，拒按，痛处固定不移，且常在夜间加重，一般伴有面色晦暗、口唇色紫、舌有瘀斑、口干但欲漱水不欲咽等症状。一般以痛如针刺，痛有定处、拒按、肿块、唇舌爪甲紫暗、脉涩等为辨证要点。面色枯槁（E错）多属脾胃气虚、营血不能上荣之故。面色青黄（A错）的临床意义，2022年考试指南未明确说明。